丝虫病患者尿液改变的特点是
A. 大量蛋白尿
B. 尿酮体阳性
C. 血红蛋白尿
D. 乳糜尿
E. 胆红素尿

正确答案：D。乳糜尿

解析：丝虫病尿液呈乳白色，同时含有较多的血液则称为乳糜血尿（D对）。当尿中蛋白质含量增加，且尿蛋白含量≥3.5g/24h，则称为大量蛋白尿，常见于肾病综合征、肾炎等疾病（A错）。糖尿病酮症酸中毒时尿酮体呈强阳性反应，接受双胍类药物治疗者会出现酮尿，但血糖、尿糖正常。妊娠剧烈呕吐、重症不能进食等亦可致尿酮体阳性（B错）。血红蛋白尿指尿中含有游离血红蛋白而无红细胞，或仅有少许红细胞而含有大量游离血红蛋白的现象。反映了血管内有超出正常的溶血。由于尿中血红蛋白含量不等，尿色可以呈红色、浓茶色，严重时呈酱油色。患者因病因不同可表现为不同症状，如阵发性睡眠性血红蛋白尿患者的血红蛋白尿容易清晨第一次尿出现。蚕豆病有进食蚕豆史或在蚕豆开花季节发生（C错）。胆红素尿常见于各种原因所致的肝细胞性及阻塞性黄疸（E错）。